传染病的病原学检查不包括
A. 分离培养病原体
B. 检测特异性核酸
C. 检测特异性抗原
D. 直接检查病原体
E. 检测特异性抗体

正确答案：E。检测特异性抗体

解析：传染病的病原学检查包括直接检查病原体（D对）、分离培养病原体（A对）、检测特异性核酸（B对）、检测特异性抗原（C对）。检测特异性抗体为实验室检查方法之一，并非病原学检查（E错，为本题正确答案）。